完整的循证医学实践过程不包括
A. 提出一个临床实践问题
B. 寻找一个临床实践问题
C. 严格评价证据
D. 寻找回答这一问题的最佳证据
E. 后效评价

正确答案：B。寻找一个临床实践问题